下列哪项属于生理性磨损
A. 正常咀嚼造成的磨损
B. 刷牙造成的楔状缺损
C. 不良习惯造成的磨损
D. 某些特殊职业造成的磨损
E. 磨牙症造成的磨损

正确答案：A。正常咀嚼造成的磨损

解析：本题考查生理性磨损。生理性磨损又称为磨耗，是指正常咀嚼造成的磨损（A对）。刷牙造成的楔状缺损（B错）、不良习惯造成的磨损（C错）、某些特殊职业造成的磨损（D错）、磨牙症造成的磨损（E错）都是病理性磨损，即正常咀嚼运动之外，高强度、反复的机械摩擦造成的牙体硬组织的快速丧失。